维持子宫颈正常位置的主要韧带是
A. 子宫阔韧带
B. 子宫圆韧带
C. 子宫主韧带
D. 子宫骶韧带
E. 无

正确答案：C。子宫主韧带

解析：子宫阔韧带（A错）可限制子宫向两侧移动；子宫圆韧带（B错）主要功能是维持子宫前倾；子宫主韧带（C对）是维持子宫颈正常位置的主要韧带；子宫骶韧带（D错）协同子宫圆韧带维持子宫的前倾前屈位。